婴儿期的心理健康应该注意的内容不包括
A. 训练婴儿唱歌的能力
B. 应鼓励婴儿开口说话，增加语言交流机会
C. 训练婴儿的各种肢体动作
D. 培养婴儿良好的进食习惯
E. 培养婴儿良好的起居习惯

正确答案：A。训练婴儿唱歌的能力